角膜的哪种说法是错误的
A. 眼球外膜的前2/6
B. 无色透明
C. 后缘接巩膜
D. 无血管，但神经末梢丰富
E. 无

正确答案：A。眼球外膜的前2/6

解析：角膜占纤维膜（即眼球壁最外层，也称眼球外膜）的前1/6（A错，为本题正确答案），无色透明（B对），无血管，但神经末梢丰富（D对），后缘接巩膜（C对）。